有关内脏神经描述中，何者是错误的
A. 内脏大神经为交感神经节后纤维
B. 含有副交感纤维的脑神经为动眼、面、舌咽和迷走神经
C. 器官内不存在交感神经节
D. 同一器官大多同时受交感神经和副交感神经双重支配
E. 肾上腺髓质只接受交感神经节前纤维支配

正确答案：A。内脏大神经为交感神经节后纤维

解析：脏大神经由穿过第5或第6-9胸交感干神经节的节前纤维组成（A错，为本题正确选项）。脑神经中的内脏运动纤维，属于副交感成分，且仅存在于动眼神经、面神经、舌咽神经和迷走神经（B对）。交感神经节位于脊柱两旁（椎旁神经节）和脊柱前方（椎前神经节）（C对）。交感神经和副交感神经都是内脏运动神经，常共同支配一个器官，形成对内脏器官功能的双重神经支配（D对）。肾上腺髓质只接受交感神经支配（E对）。